使微粒表面由固-气二相结合状态转成固-液二相结合状态的附加剂
A. 助悬剂
B. 稳定剂
C. 润湿剂
D. 反絮凝剂
E. 絮凝剂

正确答案：C。润湿剂

解析：本题考查混悬剂。润湿剂（C对）是指能增加疏水性药物微粒被水润湿能力的附加剂。润湿剂的作用主要是吸附于微粒表面降低界面张力，提高疏水性药物的亲水性，使之容易被润湿、分散。润湿剂的这些特性可使微粒表面由固-气二相结合状态转成固-液二相结合状态。助悬剂（A错）是指能增加分散介质的黏度以降低药物微粒的沉降速度或增加微粒亲水性的附加剂。稳定剂（B错）是在混悬剂中起润湿、助悬、絮凝或反絮凝作用的附加剂。反絮凝剂（D错）是指能使混悬剂产生反絮凝作用的附加剂。絮凝剂（E错）能使混悬剂产生絮凝作用的附加剂。